不属于慢性风湿性心脏病病变的是
A. 心肌间质小瘢痕形成
B. 心包纤维素渗出
C. 主动脉瓣增厚、缩短、变形
D. McCallum斑
E. 二尖瓣增厚、缩短、变形

正确答案：B。心包纤维素渗出

解析：慢性风湿性心脏病病变可以表现为1.风湿性心内膜炎：多累及二尖瓣和主动脉瓣，引起瓣膜增厚、缩短、变形（CE对）；由于病变所致瓣膜口狭窄或关闭不全，受血流反流冲击较重，引起内膜灶状增厚，称为McCallum斑（D对）。2.风湿性心肌炎：主要累及心肌间质，可见Aschoff小体，Aschoff小体机化形成小瘢痕（A对）。3.风湿性心外膜炎：主要累及心外膜脏层（B错，为本题正确答案），可有浆液或纤维素渗出。